以补开塞为
A. 反治
B. 正治
C. 标本兼治
D. 扶正祛邪
E. 扶正固表

正确答案：A。反治

解析：本题考查的是反治。以补开塞为反治（A对）。反治，又称从治，是指顺从疾病证侯的外在假象而治的治疗法则。反治，主要包括热因热用、寒因寒用、塞因塞用、通因通用四种治法。1.热因热用：热因热用又称“以热治热”。2.寒因寒用：寒因寒用又称“以寒治寒”。3.塞因塞用：塞因塞用又称“以补开塞”。4.通因通用：通因通用又称“以通治通”。正治（B错）：又称逆治，是指采用方药的性质与疾病的证候性质相反的治疗法则。常用的治法有寒者热之、热者寒之、虚则补之、实则泻之等。标本兼治（C错）：标本兼治，指在标本俱急、或标本俱缓时，当标本同时进行治疗。扶正祛邪（D错）：所谓扶正，即是扶助正气、增强体质、提高机体抗邪能力。所谓祛邪，即是祛除病邪，使邪去正安。扶正固表（E错）的内容，2022年考试指南未明确说明。